由县级以上卫生行政部门给予警告，可以根据情节处以3千元以下的罚款的医疗机构情形是
A. 未取得放射诊疗许可从事放射诊疗工作的
B. 未办理诊疗科目登记或者未按照规定进行校验的
C. 未经批准擅自变更放射诊疗项目
D. 超出批准范围从事放射诊疗工作的
E. 以上说法均正确

正确答案：E。以上说法均正确

解析：医疗机构有下列情形之一的，由县级以上卫生行政部门给予警告、责令限期改正，并可以根据情节处以3千元以下的罚款；情节严重的，吊销其《医疗机构执业许可证》：①未取得放射诊疗许可从事放射诊疗工作的；②未办理诊疗科目登记或者未按照规定进行校验的；③未经批准擅自变更放射诊疗项目或者超出批准范围从事放射诊疗工作的。掌握“放射诊疗的防护与法律责任”知识点。